预后最差的肺癌是
A. 鳞形细胞癌
B. 小细胞癌
C. 腺癌
D. 大细胞癌
E. 细支气管肺泡癌

正确答案：B。小细胞癌

解析：肺癌的病理类型包括：鳞状细胞癌，占50％，多见于50岁以上男性，常有吸烟史，常为中央型，对放化疗中度敏感，先经淋巴结转移，血行转移较晚；小细胞癌，发病年龄较轻，男性病人多，中央型为主，高度恶性，较早发生淋巴结和血行转移，对放化疗敏感；腺癌发病年龄较小，女性病人多，常为周围型，生长较慢，但可在早期发生血行转移，淋巴结转移较晚；细支气管肺泡癌是腺癌的一种类型，分化程度高，转移发生晚，不侵犯肺泡间隔，可侵犯胸膜或经支气管播散；大细胞癌少见，预后差，转移早，中心型为主。故选B。掌握“肺癌”知识点。